下列关于传染病学暴发流行的叙述，正确的是
A. 集中于某一人群
B. 集中于某一职业
C. 集中于某一时间
D. 集中于某一地区
E. 集中于某一年龄

正确答案：C。集中于某一时间

解析：传染病流行过程中可呈散发、暴发、流行及大流行。1.暴发流行：暴发：某传染病病例集中发生于一个短时间内（C对）。2.散发性发病：某传染病在某地的常年发病情况处于常年一般发病率水平。3.流行：某种传染病在某地区的发病率水平高于一般水平。4.大流行：某传染病的流行范围甚广，波及全国各地，甚至超出国界或洲界。